影响神经纤维动作电位幅度的主要因素是
A. 刺激强度
B. 刺激时间
C. 阈电位水平
D. 细胞内外的Na⁺浓度
E. 神经纤维的直径

正确答案：D。细胞内外的Na⁺浓度

解析：动作电位幅度=静息电位的绝对值+超射值。若增加细胞外的Na⁺浓度（D对），会加大细胞外液与细胞内液之间的浓度差，Na⁺内流增多，超射值增大，动作电位幅度增大，反之亦然。改变刺激时间（B错）、刺激强度（A错）和阈电位水平（C错），可以改变动作电位发生的难易程度，但不会影响动作电位幅度，因动作电位具有“全或无”的特性。神经纤维的直径（E错）可以影响神经纤维动作电位的传导速度，不会影响动作电位幅度。